支配颊肌的神经是
A. 颊神经
B. 面神经
C. 下颌舌骨肌神经
D. 下颌神经
E. 无

正确答案：B。面神经

解析：面神经（B对）发出颊支，支配颊肌、口轮匝肌及其他口周围肌。